下列因素中，刺激抗利尿激素分泌最强的是
A. 循环血量減少
B. 血浆晶体渗透压增高
C. 血浆胶体渗透压增高
D. 饮大量清水
E. 血容量减少

正确答案：B。血浆晶体渗透压增高

解析：抗利尿激素又称血管升压素，其合成和分泌受多种因素调节：①体液渗透压增高是最重要的刺激因素，由于晶体渗透压是血浆渗透压的主要组成成分，因此血浆晶体渗透压增高（B对CD错）是刺激抗利尿激素分泌的最强的因素：②血容量减少（E错），循环血量减少（A错）时，经心肺感受器和迷走神经作用也能刺激抗利尿激素分泌，但相对于血浆晶体渗透压升高来说，是次要因素。